男性，9岁。上颌前牙外伤8小时。口腔检查：右上1已萌出，松动Ⅰ°，叩痛（+），牙齿纵向冠根折裂，舌侧呈游离状。处理方法是
A. 结扎固定
B. 根管治疗
C. 一次性根管治疗后钉固位修复
D. 拔除
E. 拔除牙冠，保留牙根

正确答案：D。拔除

解析：本题考查冠根联合折的治疗。男性，9岁。上颌前牙外伤8小时。口腔检查：右上1已萌出，松动Ⅰ°，叩痛（+），牙齿纵向冠根折裂，舌侧呈游离状。处理方法是拔除（D对）。前牙的冠根联合纵折表现为折断线累及牙冠和根部，均与口腔相通，牙髓常已暴露，牙松动明显，叩痛（+）～（+++），其断端游离无法保留，多数患牙需拔除。由于患牙冠根纵裂，因而牙根也已折裂，无保留的价值，应完全拔出（E错），不必再施行保留患牙的治疗措施如结扎固定、根管治疗、钉固位修复等（ABC错）。